下列分析方法中，属于氧化还原滴定法的有
A. 酸碱滴定法
B. 非水碱量法
C. 非水酸量法
D. 碘量法
E. 铈量法

正确答案：D、E。碘量法；铈量法

解析：本题考查氧化还原滴定法。碘量法（D对）、铈量法（E对）属于氧化还原法。氧化还原滴定法是以溶液中氧化剂和还原剂之间的电子转移为基础的一种滴定分析方法，包括铈量法、碘量法、溴量法、溴酸钾法、重铬酸钾法、高锰酸钾法及亚硝酸钠法等。滴定分析法分为：（1）酸碱滴定法（A错）；（2）非水溶液滴定法：①非水碱量法（B错）、②非水酸量法（C错）；（3）氧化还原法。